白附子的功效是
A. 消痞散结
B. 祛风止痉
C. 理气调中
D. 除烦止呕
E. 润肺止咳

正确答案：B。祛风止痉

解析：本题考查白附子的功效。白附子的功效是祛风止痉（B对）。白附子【功效】燥湿化痰，祛风止痉，解毒散结。半夏【功效】燥湿化痰，降逆止呕，消痞散结（A错）。陈皮【功效】理气调中（C错），燥湿化痰。芦根【功效】清热生津，除烦止呕（D错），利尿。川贝母【功效】清热化痰，润肺止咳（E错），散结消痈。